患者头面肢体水肿，按之凹陷不易起，小便短少不利，身体困重，舌淡胖，苔白滑，脉濡缓，其临床意义是
A. 痰证
B. 饮证
C. 水停证
D. 悬饮
E. 支饮

正确答案：C。水停证

解析：水为有形之邪，水液输布失常而泛溢肌肤，故出现头面肢体水肿，按之凹陷不易起；水液停聚，膀胱气化失司，故见小便短少不利；水湿困脾，湿渍肢体，则身体困重；舌淡胖，苔白滑，脉濡缓均为水湿内停之征；故辨证为水停证（C对）。咳吐痰多、胸闷、呕恶、眩晕、体胖、局部圆韧包块、苔腻、脉滑等为痰证的主要表现（A错）。胸闷脘痞，呕吐清水，咳吐清稀痰涎，肋间饱满，苔滑，脉弦为饮证的主要表现（B错）。饮停于胸胁，阻碍气机，肋间饱满，咳唾引痛，胸闷息促为悬饮的主要表现（D错）。饮停于心肺，阻遏心阳，则胸闷，心悸，息促不得卧是支饮的主要表现（E错）。